目前我国医学伦理学主要的研究方向是
A. 公民道德问题
B. 临床医学问题
C. 公共道德的学说和体系
D. 生命科学的发展
E. 医学实践中的道德问题

正确答案：E。医学实践中的道德问题